男，72岁。尿频、排尿困难、尿不成线半年余。曾发生急性尿潴留4次。经检查确诊为良性前列腺增生。肺、肝、肾功能检查未见异常。最佳的治疗方法是
A. 长期留置导尿管
B. 服用5α-还原酶抑制剂
C. 手术治疗
D. 抗感染治疗
E. 尿道扩张

正确答案：C。手术治疗

解析：老年男性患者患有良性前列腺增生，尿频排尿困难半年余，发生急性尿潴留4次，症状严重有明显梗阻。查体一般情况良好，肺肝肾功能检查未见异常，应首选手术治疗（ C对）。长期留置导尿管（A错）易引发泌尿系感染不可取。服用5α-还原酶抑制剂（B错）主要用于症状较轻的患者。抗感染治疗（D错）为合并泌尿系统感染者的治疗手段，该病例并无明显感染症状。尿道扩张（E错）不能用于发生过尿潴留的严重尿道梗阻患者。